关于牙骨质龋的病理表现叙述错误的是
A. 牙骨质龋的细菌通道为穿通纤维
B. 早期表层矿化较好，但是表层下脱矿
C. 相应牙本质的髓腔侧出现修复性牙本质
D. 牙骨质龋进展较快，会很快进展到牙本质
E. 发生颈部的牙本质龋比冠部的牙本质龋进展快

正确答案：E。发生颈部的牙本质龋比冠部的牙本质龋进展快

解析：本题考查牙骨质龋。关于牙骨质龋的病理表现叙述错误的是发生颈部的牙本质龋比冠部的牙本质龋进展快（E错，为本题正确答案）。牙骨质中的细菌可沿与牙面垂直的穿通纤维向深层进展，也可沿与牙面平行的生长线及层板状结构向牙骨质上、下扩展。牙骨质龋早期表层矿化良好，而表层下脱矿。当牙骨质龋进展缓慢时，在相应的牙髓腔也可出现类似于冠部牙本质龋发生时的修复反应，即形成修复性牙本质。由于颈部牙骨质较薄，牙骨质龋进展较快，所以病变很快进展到牙本质，但是由于年龄增大，牙本质小管钙化封闭，故发生牙颈部的牙本质龋进展反而慢于冠部牙本质龋。